大豆经发芽后制成豆芽的过程中含量明显增加的营养素是
A. 膳食纤维
B. 维生素C
C. 维生素D
D. 碳水化合物
E. 钾

正确答案：B。维生素C

解析：本题考查大豆经发芽后制成豆芽的过程中含量明显增加的营养素。大豆经浸泡和保温发芽后制成豆芽，在发芽的过程中维生素C（B对ACDE错）的含量明显增加，从0增至5～10mg/100g左右。